下列有关双相障碍的诊断正确的是
A. 主要依据临床表现特点和实验室检查进行
B. 当患者在病程中先后出现过躁狂发作和抑郁发作，并排除其他躯体、脑器质性精神障碍、精神活性物质所致精神障碍等可以诊断
C. 当患者在病程中先后出现过躁狂发作和抑郁发作即可诊断。
D. 当患者在病程中先后出现过躁狂发作和抑郁发作，仅仅排除其他躯体所致精神障碍即可以诊断
E. 当患者在病程中先后出现过躁狂发作和抑郁发作，仅仅排除脑器质性精神障碍、精神活性物质所致精神障碍即可以诊断

正确答案：B。当患者在病程中先后出现过躁狂发作和抑郁发作，并排除其他躯体、脑器质性精神障碍、精神活性物质所致精神障碍等可以诊断